足月妊娠时的胎心率正常值应是每分钟
A. 90～130次
B. 100～140次
C. 110～160次
D. 120～160次
E. 130～170次

正确答案：C。110～160次

解析：足月妊娠时的胎心率（FHR）正常值应是每分钟110～160次（C对）。